某女性，从事高温作业4小时后，感觉剧烈头痛，并迅速进人浅昏迷状态，体温39.5℃，则其最可能的中暑类型是
A. 机体蓄热
B. 热射病
C. 热痉挛
D. 热衰竭
E. 水、电解质平衡紊乱

正确答案：B。热射病